宫内节育器的避孕原理是
A. 抑制排卵
B. 屏障避孕作用
C. 改变宫颈黏液性质
D. 改变子宫内环境，阻止受精卵着床
E. 避免精子与卵子相遇

正确答案：D。改变子宫内环境，阻止受精卵着床

解析：本题考查宫内节育器的避孕原理。宫内节育器俗称避孕环，是一种安全、长效、经济、简便的避孕工具。将宫内节育器放置在子宫内，能够避孕数年，取出后可以很快恢复生育力，是我国育龄妇女选用最多的一种避孕方法。放置宫内节育器后，可以改变子宫内环境，阻止受精卵着床（D对ABCE错），含铜宫内节育器的铜离子还具有杀伤精子或受精卵的作用。